可见光区的波长范围是
A. 100～200nm
B. 200～400nm
C. 400～760nm
D. 760～2500nm
E. 2.5～25㎛

正确答案：C。400～760nm

解析：本题考查常用的药品鉴别方法。光谱分析法所用的波长范围包括从紫外光区至红外光区。光谱范围大致分为紫外区（190～400nm）（AB错）、可见区（400～760nm）（C对）、近红外区（760～2500nm）（D错）、红外区（2.5μm～40μm或4000～250cm⁻¹）（E错）。